以下哪一项可作为牙尖交错位的影响因素
A. 一侧咬肌痉挛
B. 髁突发育异常
C. 下颌骨骨折移位
D. 髁突重度骨质吸收
E. 以上均是

正确答案：E。以上均是

解析：牙尖交错位的影响因素：①牙尖交错（牙合）异常；②肌功能异常；如一侧咬肌痉挛，可使下颌在牙尖交错位时出现偏斜，上下牙不能达到最广泛、最紧密的接触；③颞下颌关节异常；如髁突发育异常、髁突重度骨质吸收、下颌骨骨折移位等，都会造成咬合接触的异常，上下颌牙不能达到最广泛、最紧密的接触。掌握“牙尖交错位、后退接触位与正中关系”知识点。